急性头痛伴眩晕的是
A. 椎-基底动脉供血不足
B. 鼻源性头痛
C. 肌收缩性头痛
D. 偏头痛
E. 急性青光眼

正确答案：A。椎-基底动脉供血不足

解析：由于脑动脉粥样硬化、颈椎病等原因导致椎-基底动脉系统供血障碍，从而出现眩晕、视觉障碍、头痛等症状（A对）；鼻源性头痛是指由鼻腔、鼻窦、鼻咽部病变引起的头痛。鼻部病变可直接刺激鼻黏膜三叉神经末梢引起头痛，并可沿其分支放射至头部相应部位（B错）；肌收缩性头痛主要表现为额头、太阳穴和头后部出现紧箍样疼痛（C错）；偏头痛表现为一侧或两侧搏动性头痛，常伴恶心和呕吐（D错）；急性青光眼常见症状为视力急剧下降、剧烈头痛、眼痛、畏光、流泪等（E错）。